老年人对苯二氮䓬类药较为敏感，用药后可致平衡功能失调，觉醒后可发生步履蹒跚、思维迟缓等症状，在临床上被称为
A. 震颤麻痹综合征
B. 老年期痴呆
C. “宿醉”现象
D. 戒断综合征
E. 锥体外系反应

正确答案：C。“宿醉”现象

解析：本题考查苯二氮䓬类药物。老年患者对苯二氮䓬类药物更敏感，服用后，可产生过度镇静、肌肉松弛作用，觉醒后思维迟缓、步履蹒跚、肌无力，称为“宿醉”现象（C对）；震颤麻痹综合征（A错）又称帕金森病，老年期痴呆（B错）又称阿尔茨海默症，伴随脑功能减退，严重者甚至出现痴呆；戒断反应（D错）是指停止使用药物或减少使用剂量或使用拮抗剂占据受体后所出现的症状表现；锥体外系反应（E错）是人体运动系统发生的症候。